前腭突是双侧球状突与哪个突起联合形成
A. 中鼻突
B. 上颌突
C. 侧腭突
D. 侧鼻突
E. 鼻中隔

正确答案：B。上颌突

解析：双侧球状突互相联合及与上颌突联合的过程中，不断向口腔侧增生，形成了前腭突。掌握“腭部与舌的发育”知识点。